乳核相当于西医学的
A. 急性乳腺炎
B. 乳腺纤维腺瘤
C. 乳房结核
D. 乳房发育异常症
E. 乳晕部瘘管

正确答案：B。乳腺纤维腺瘤

解析：乳核是指乳腺小叶内纤维组织和腺上皮的良性肿瘤，相当于西医学的乳腺纤维腺瘤（B对）。乳痈相当于西医学的急性化脓性乳腺炎（A错）。乳痨相当于西医学的乳房结核（C错）。乳疬相当于西医学的乳房异常发育症（D错）。粉刺性乳痈是发生于非哺乳期和非妊娠期妇女的慢性化脓性乳腺疾病，常有乳头凹陷或溢液，化脓溃破后脓液中夹有粉刺样物质，易反复发作，形成瘘管，经久难愈，全身症状较轻，本病相当于西医学的浆细胞性乳腺炎、肉芽肿性乳腺炎、乳腺导管扩张症等（E错）。